3-位有甲基，7-位有2-氨基苯乙酰氨基
A. 头孢氨苄
B. 头孢羟氨苄
C. 头孢噻吩钠
D. 头孢噻污钠
E. 头孢哌酮

正确答案：A。头孢氨苄